男，53岁。上腹胀痛10余年，多于饭后约30分钟加重。半年来上腹痛加重，伴反酸，间断呕吐胃内容物。吸烟15年，饮白酒10年，每日约半斤。患者的病变最可能位于
A. 十二指肠球部
B. 胃窦
C. 胃体
D. 贲门
E. 胃底

正确答案：B。胃窦

解析：老年男性患者，上腹胀痛病史10余年，餐后加重（节律性上腹餐后痛），半年来腹痛伴反酸、呕吐，考虑为胃溃疡。胃溃疡病变最可能位于胃角和胃窦（B对），少见于胃体（C错）、贲门（D错）与胃底（E错）。十二指肠球部（A错）病变见于十二指肠溃疡，其主要症状为饥饿痛与夜间痛。